下列能够促进膳食铁吸收的因素是
A. 植酸
B. 草酸
C. 胃酸过多
D. 维生素C
E. 多酚

正确答案：D。维生素C